有关RNA的叙述，错误的是
A. tRNA是氨基酸的载体
B. hnRNA主要存在于胞质
C. rRNA参与核蛋白体组成
D. mRNA具有多聚A尾结构
E. mRNA分子中含有遗传密码

正确答案：B。hnRNA主要存在于胞质